倍他洛尔所致的主要不良反应
A. 血尿酸升高
B. 支气管痉挛
C. 血钠升高
D. 外周血肿
E. 血钾升高

正确答案：B。支气管痉挛

解析：本题考查药物的不良反应。倍他洛尔所致的主要不良反应是支气管痉挛（B对）。β受体阻断剂（倍他洛尔）主要不良反应：支气管痉挛、心功能抑制。血尿酸升高（A错）是噻嗪类利尿药的不良反应。血钾升高（E错）是保钾利尿药的不良反应。